下述哪种病毒是DNA病毒
A. HAV
B. HBV
C. HCV
D. HDV
E. HEV

正确答案：B。HBV

解析：本题考查病毒性肝炎的病因学。HBV（B对）是DNA病毒，HAV（A错）、HCV（C错）、HDV（D错）、HEV（E错）均为RNA病毒。